药物熔点测定的结果可用于
A. 确定药物的类别
B. 考察药物的溶解度
C. 反映药物的纯度
D. 检查药物的均一性
E. 检查药物的结晶性

正确答案：C。反映药物的纯度

解析：本题考查药品标准检查项下的内容。药物熔点测定的结果可用于反映药物的纯度（C对）。不同药品的熔点通常是不同的，所以测定药品的熔点可以辅助鉴别该药品的真伪。如果该药品的纯度下降，会导致熔点下降、熔距增长，因此熔点也可以反映出药品的纯度。溶解度（B错）是药品的一种物理性质，与熔点无关。均一性（D错）主要是检查制剂的均匀程度，用重量差异、含量均匀度等检查。药物的结晶性（E错）属于药品性状中的外观。结晶性检查法：固态物质分为结晶质和非晶质两大类。可用偏光显微镜法或 射线粉末衍射法检查物质的结晶性。